患者体内有维生素B₁₂辅助因子的抗体，此抗体可使肠道维生素B₁₂吸收障碍，该种贫血属于
A. ABO血型不符
B. 新生儿溶血症
C. 自身免疫性溶血性贫血
D. 恶性贫血
E. 药物过敏性溶血性贫血

正确答案：D。恶性贫血

解析：恶性贫血是因胃黏膜萎缩、胃液中缺乏内因子，使维生素B₁₂吸收出现障碍而发生的巨幼细胞贫血。发病机制不清楚，与种族和遗传有关。90%左右的患者血清中有壁细胞抗体，60%的患者血清及胃液中找到内因子抗体，部分患者可出现甲状腺抗体。恶性贫血可见于甲状腺功能亢进、慢性淋巴细胞性甲状腺炎、类风湿关节炎等疾病。恶性贫血的治疗为补充维生素B₁₂，需要终生维持治疗。